旁路途径的激活物质是
A. IgG或IgM
B. C3b
C. MBL
D. CR
E. 酵母多糖类

正确答案：E。酵母多糖类

解析：旁路激活途径的激活物：某些细菌、革兰阴性菌的内毒素、酵母多糖、葡聚糖、凝聚的IgA和IgG4以及其它哺乳动物细胞。掌握“补体的概念，激活途径及调节”知识点。